右心室肥大心尖搏动的位置为
A. 向左下移位
B. 向右移位
C. 向右上移位
D. 向左上移位
E. 向左移位

正确答案：E。向左移位

解析：左心室增大时及左右心室均增大时，心尖搏动向左下移位（A错）；右心室增大时，心尖搏动向左侧移位（E对）。